关于固体分散物的说法，正确的有
A. 药物以分子、胶态、微晶或无定形状态分散在载体材料中
B. 载体材料包括水溶性、难溶性和肠溶性三类
C. 可使液体药物固体化
D. 药物的分散状态好，稳定性高，易于久贮
E. 固体分散物不能进一步制成注射液

正确答案：A、B、C。药物以分子、胶态、微晶或无定形状态分散在载体材料中；载体材料包括水溶性、难溶性和肠溶性三类；可使液体药物固体化

解析：本题考查固体分散体。药物可以以分子、胶态、微晶或无定形态分散（A对）在载体材料中形成固体分散体。载体材料有水溶性、难溶性、肠溶性三种（B对）；可使液体药物固化（C对）；固体分散体存在的主要问题是不够稳定，易老化，久贮易老化（D错）；固体分散体可以制成多种剂型包括注射剂、胶囊剂、微丸剂、滴丸剂、软膏剂及栓剂等（E错）。